革兰阳性菌与革兰阴性菌细胞壁化学组成的共同成分是
A. 肽聚糖
B. 磷壁酸
C. 外膜
D. 脂多糖
E. 脂蛋白

正确答案：A。肽聚糖

解析：本题考查细菌的大小、形态和基本结构。革兰氏阳性菌肽聚糖组成：聚糖、侧链、交联桥；革兰氏阴性菌肽聚糖组成：聚糖（A对）、侧链。